不与延髓相连的脑神经是
A. 副神经
B. 迷走神经
C. 三叉神经
D. 舌下神经
E. 舌咽神经

正确答案：C。三叉神经

解析：不与延髓相连的脑神经是三叉神经（C对），三叉神经与脑桥相连。副神经（A错）、迷走神经（B错）、舌下神经（D错）、舌咽神经（E错）均与延髓相连。